《医疗机构管理条例》规定，医疗机构不得使用非卫生技术人员从事的工作为
A. 医疗后勤服务
B. 医疗卫生技术
C. 医院安全保卫
D. 医院财务审计
E. 医疗器械采购

正确答案：B。医疗卫生技术

解析：《医疗机构管理条例》规定，医疗机构不得使用非卫生技术人员从事医疗卫生技术（B对）工作。医疗机构可以使用非卫生技术人员从事医疗后勤服务（A错）、医院安全保卫（C错）、医院财务审计（D错）、医疗器械采购（E错）等非医疗卫生技术工作。